急性牙槽脓肿发展过程经历的三个临床阶段为
A. 浆液期、化脓期、引流期
B. 根尖脓肿、骨膜下脓肿、黏膜下脓肿
C. 根尖脓肿、根尖肉芽肿、根尖囊肿
D. 急性根尖炎、慢性根尖炎、慢性牙槽脓肿
E. 根尖脓肿、骨膜下脓肿、面部间隙感染

正确答案：B。根尖脓肿、骨膜下脓肿、黏膜下脓肿

解析：牙槽脓肿可分以下三期：①根尖脓肿期；②骨膜下脓肿期；③黏膜下脓肿期。掌握“急性根尖周炎”知识点。